下列哪一项不支持急进性肾小球肾炎的诊断
A. 呈急性肾炎综合征
B. 肾功能急剧转坏
C. 早期出现少尿性急性肾功能衰竭
D. 数周至半年进展至尿毒症
E. 常无贫血表现

正确答案：E。常无贫血表现

解析：急进型肾小球肾炎患者球旁细胞损伤，球旁细胞分泌的促红细胞生成素（EPO）减少，导致红细胞生成减少；且肾小球滤过膜损伤，血细胞还会随尿液排出，故急进型肾小球肾炎患者常伴有中度贫血（E错，为本题正确答案）。急进型肾小球肾炎是呈急性肾炎综合征（A对）、肾功能急剧转坏（B对），多在早期出现少尿性急性肾功能衰竭（C对）并发展成尿毒症（D对）等临床特征的一组疾病。